某男，1岁。不思乳食，呕吐酸腐，大便溏泄；舌苔白腻，脉细而滑。诊断为积滞，证属脾虚夹积。宜选用的中成药是
A. 小儿消食丸
B. 参苓白术散
C. 小儿化食丸
D. 儿宝颗粒
E. 小儿胃宝丸

正确答案：E。小儿胃宝丸

解析：本题考查积滞之脾虚夹积证的中成药应用。结合患者症状为积滞之脾虚夹积证，宜选用的中成药是小儿胃宝丸（E对）。积滞之脾虚夹积证【症状】面色萎黄，形体消瘦，神疲肢倦，不思乳食，食则饱胀，腹满喜按，大便溏稀酸腥，夹有乳片或不消化食物残渣。舌质淡，苔白腻，脉细滑，或指纹淡滞。【中成药应用】常用中成药健胃消食片、小儿胃宝丸。积滞之乳食内积证【症状】不思乳食，嗳腐酸馊，或呕吐食物、乳片，脘腹胀满疼痛，大便酸臭或便秘，烦躁啼哭，夜眠不安，手足心热。舌质红，苔白厚，或黄厚腻，脉弦滑，或指纹紫滞。【中成药应用】常用中成药保和丸（水丸）、小儿消食片（A错）、小儿化食丸（C错）、大山楂丸、四磨汤口服液。厌食之脾胃气虚证【症状】不思进食，食不知味，神倦多汗，大便溏薄夹不消化食物，面色少华，形体偏瘦，肢倦乏力。舌淡，苔薄白，脉缓无力。【中成药应用】常用中成药参苓白术散（B错）、启脾丸、儿宝颗粒（D错）。